对乙酰氨基酚过量的解毒剂
A. 亚硝酸氢钠
B. 纳洛酮
C. 硫代硫酸钠
D. 戊乙奎醚
E. 乙酰半胱氨酸

正确答案：E。乙酰半胱氨酸

解析：本题考查乙酰半胱氨酸。对乙酰氨基酚过量的解毒剂是乙酰半胱氨酸（E对）。对乙酰氨基酚过量中毒造成肝坏死，对于中毒的患者及时使用蛋氨酸（甲硫氨酸）或乙酰半胱氨酸可防止肝损伤。
纳洛酮（B错）用于阿片类药物中毒的解救。硫代硫酸钠（C错）用于氰化物中毒的解救。戊乙奎醚（D错）用于有机磷毒物（农药）中毒或胆碱酯酶（ChE）老化后维持阿托品化。